女，28岁。甲状腺肿大3年。性情急躁、怕热、多汗、心悸，食欲强但消瘦。有哮喘病史。拟行手术治疗，其术前药物准备措施应首选的是
A. 单用复方碘剂
B. 单用硫脲类药物
C. 先用硫脲类药物，后加用复方碘剂
D. 单用普萘洛尔
E. 应用普萘诺尔+硫脲类药物

正确答案：C。先用硫脲类药物，后加用复方碘剂

解析：青年女性患者，甲状腺肿大三年，同时伴有性情急躁、怕热、多汗、心悸等症状，考虑原发性甲亢，其术前药物准备措施应首选的是先用硫脲类药物，后加用复方碘剂（C对）。其中硫脲类药物可抑制甲状腺素的合成，碘剂能抑制甲状腺素的释放并使甲状腺缩小变硬，可降低患者的基础代谢率，保证手术的顺利进行并预防术后并发症。单用复方碘剂（A错）适用于症状不重以及继发性甲亢和高功能腺瘤患者，该患者甲亢症状较重，不宜采用此方法。单用硫脲类药物（B错）可使甲状腺肿大并充血，增加手术的困难及风险。患者既往存在哮喘病史，禁用β受体阻滞剂普萘洛尔，因此，不宜单用普萘洛尔（D错）作术前准备。临床上并无普萘洛尔+硫脲类药物（E错）的术前准备方案。